患者平素眩晕，耳鸣。突然发生口舌歪斜，舌强语謇，半身不遂，但其神志清楚，舌红，脉弦滑。治疗应首选
A. 大秦艽汤
B. 镇肝熄风汤
C. 龙胆泻肝汤
D. 地黄饮子
E. 苏合香丸

正确答案：B。镇肝熄风汤

解析：患者平素眩晕，耳鸣又突然发生口舌歪斜，舌强语謇，半身不遂可诊断为中风。患者神志清楚可诊断为中经络；肾阴素亏，肝阳上亢故患者平素眩晕，耳鸣，头痛；肝阳暴张，风阳上扰，血随气逆，血瘀脑脉顾半身不遂，偏身麻木；风阳上扰，舌络瘀滞故口舌歪斜，舌强语謇；肾阴亏虚，虚火内生加之肝火偏旺，灼伤津液，故口苦，尿赤，便干；舌红少苔或苔黄，脉弦数提示有热象，故为风阳上扰证，代表方为镇肝熄风汤（B对）。大秦艽汤用于治疗络脉空虚，风邪入中（A错）。龙胆泻肝汤用于胁痛肝胆湿热证（C错）。地黄饮子用于中风恢复期和后遗症期肝肾亏虚证（D错）。苏合香丸合涤痰汤治疗阴闭痰蒙神窍证（E错）。